右侧内囊出血可导致
A. 右侧肢体痉挛性瘫痪
B. 左侧肢体痉挛性瘫痪
C. 右侧肢体弛缓性瘫痪
D. 左侧肢体弛缓性瘫痪
E. 以上都不对

正确答案：B。左侧肢体痉挛性瘫痪

解析：右侧内囊出血可导致右侧皮质脊髓束受损。因右侧皮质脊髓束属于上运动神经元发出的下行纤维，控制左侧躯干、肢体运动，因而右侧皮质脊髓束受损会导致左侧肢体上运动神经元性瘫痪即痉挛性瘫痪（B对）。